为研究幽门螺杆菌感染与十二指肠溃疡的关系，开展以下研究：①调查某地324名幽门螺杆菌感染者，10年中有11%发生十二指肠溃疡；而133例非感染者仅有0.8%发生十二指肠溃疡，RR=13.75。②临床预后比较抗菌治疗组：用三联抗菌清除幽门螺杆菌，该组溃疡复发率为0。非抗菌治疗组：用组胺拮抗剂治疗，该组溃疡复发率为60%～80%。结论：幽门螺杆菌是十二指肠溃疡的病因之一。10年中，幽门螺杆菌感染者11%发生十二指肠溃疡，而133例非感染者仅有0.8%发生十二指肠溃疡，RR＞10，P＜0.05。该结论符合病因推断标准中的
A. 关联的一致性
B. 关联的重复性
C. 剂量﹣反应关系证据
D. 关联时间顺序和关联强度证据
E. 关联合理性证据

正确答案：D。关联时间顺序和关联强度证据